制订医院用药目录的药物经济学目的是
A. 指导新药研制
B. 指导新药生产
C. 规范医生用药
D. 研究药物适用范围
E. 帮助病人选择药物

正确答案：C。规范医生用药

解析：本题考查的是药物经济学的目的。制订医院用药目录的药物经济学目的是规范医生用药（C对）。让病人使用成本低、效果好的药品，其药物经济学目的是帮助病人选择药物（E错）。